对于C类型的预防性树脂充填，应该使用的修复材料为
A. 不含填料的封闭剂
B. 流动树脂材
C. 复合树脂材料
D. 玻璃离子
E. 氧化锌丁香油

正确答案：C。复合树脂材料

解析：类型C预防性树脂充填：用中号或较大圆钻去除龋坏组织，洞深已达牙本质需垫底，涂布牙本质或牙釉质黏结剂后用后牙复合树脂材料充填。掌握“预防性树脂充填”知识点。